腹膜为全身面积最大的浆膜，薄而光滑，呈半透明状，壁腹膜和脏腹膜相互移行围成一浆膜腔，称腹膜腔。腹膜有分泌、吸收、支持、固定、修复和防御等功能。腹膜从腹、盆壁移行于脏器或脏器间相互移行形成许多结构，主要有网膜、系膜、韧带和陷凹等。关于腹膜的功能错误的是
A. 较强的吸收能力
B. 对脏器有修复功能
C. 对脏器有支持和固定作用
D. 防御功能
E. 可分泌浆液促进伤口的愈合及炎症的局限，但不造成肠襻粘连

正确答案：E。可分泌浆液促进伤口的愈合及炎症的局限，但不造成肠襻粘连

解析：腹膜在上腹部特别是膈下区有较强的吸收能力(A对)，对脏器有修复(B对)、支持和固定作用(C对)，还具有防御功能(D对)，可分泌浆液促进伤口愈合及炎症局限化，但粗暴的手术操作或腹膜长时间暴露于空气中可能会造成肠襻粘连(E错，为本题正确答案)。